既是原穴，又是八会穴的腧穴是
A. 太渊
B. 合谷
C. 后溪
D. 外关
E. 太溪

正确答案：A。太渊

解析：太渊既为手太阴肺经的原穴，又为脉会（A对）。合谷为手阳明大肠经的原穴，但非八会穴（B错）。后溪为手太阳小肠经的输穴（C错）。外关为手少阳三焦经的络穴（D错）。太溪为足少阴肾经的原穴（E错）。